男，56岁，右侧阴囊部隐痛2个月，查体：右侧阴囊比左侧增大，触之有硬结与睾丸黏连，边界不清，有轻微触痛，首先应考虑的诊断是
A. 睾丸结核
B. 睾丸肿瘤
C. 腹股沟斜疝
D. 睾丸鞘膜积液
E. 睾丸炎

正确答案：B。睾丸肿瘤

解析：中老年男性患者，右侧阴囊部隐痛，触之有硬结与睾丸黏连，边界不清，符合睾丸肿瘤的诊断（B对）。睾丸结核（A错）有低热、盗汗、乏力等结核中毒症状，抗酸杆菌检测、结核杆菌培养有助于诊断。腹股沟斜疝（C错）多见于儿童及青壮年，疝块呈椭圆或梨形，多为明显疼痛。睾丸鞘膜积液（D错）透光试验阳性，触之为囊性而不是硬结。睾丸炎（E错）表现为阴囊有坠胀痛，休息后好转。